出现“爪形手＂，是何神经损伤所致
A. 肌皮神经
B. 尺神经
C. 桡神经
D. 正中神经
E. 无

正确答案：B。尺神经

解析：肌皮神经（A错）损伤时表现为屈肘无力以及前臂外侧部皮肤感觉的减弱。尺神经（B对）损伤导致，掌指关节过伸，出现“爪形手”。桡神经（C错）损伤导致前臂伸肌群的瘫痪，表现为抬前臂时呈“垂腕”状。正中神经（D错）损伤导致表现为鱼际肌萎缩，手掌变平呈＂猿掌”。